关于六味安消散使用注意的说法，错误的是
A. 脾胃虚寒之胃痛、便秘者慎用
B. 热结血瘀痛经者慎用
C. 服药期间戒烟酒
D. 服药期间忌饮茶
E. 对其过敏者忌服

正确答案：D。服药期间忌饮茶

解析：本题考查的是六味安消散的注意事项。六味安消散服药期间不忌饮茶（D错，为本题正确答案）。六味安消散：【注意事项】对本品过敏者忌服（E对）。脾胃虚寒之胃痛、便秘，以及热结血瘀痛经者慎用（AB对）。孕妇忌用。服药期间，饮食宜清淡，忌食辛辣、刺激性食物，戒烟、酒（C对）。服药期间忌饮茶为健脾生血颗粒的注意事项。健脾生血颗粒：【注意事项】本品含有硫酸亚铁，对胃有刺激性，故宜在饭后服用。服药期间，忌饮茶，勿与含鞣酸类药物合用；部分患儿可出现牙齿颜色变黑，停药后可逐渐消失。少数患儿服药后，可见短暂性食欲下降、恶心、呕吐、轻度腹泻，多可自行缓解。饮食宜清淡，忌食油腻、辛辣食物，要改善饮食，加强营养，合理添加蛋黄、瘦肉、肝、肾、豆类、绿色蔬菜及水果等。若以本品治疗小儿缺铁性贫血应结合病因冶疗。